用人工方法，让卵子和精子在人体以外受精和发育的生殖方法
A. 体外受精
B. 克隆技术
C. 人工授精
D. 异体受孕
E. 代孕母亲

正确答案：A。体外受精

解析：体外受精：用人工方法，让卵子和精子在人体以外受精和发育的生殖方法。掌握“人类生殖技术伦理”知识点。